牙体缺损至牙龈下3mm修复治疗选什么
A. 桩核冠
B. 全冠
C. 树脂充填
D. 银汞充填
E. 正畸牵引

正确答案：E。正畸牵引

解析：本题考查修复前正畸治疗。牙体缺损至牙龈下3mm修复治疗选正畸牵引（E对）。正畸牵引时应准确估计牙被牵出的距离，以防止修复体边缘龈下过分延伸，便于形成有效的修复体颈部箍效应。桩核冠（A错）：多用于牙冠大部分缺损，不能直接充填治疗或全冠修复固位不良者。全冠（B错）：多用于牙体严重缺损，固位形、抗力形较差者；需恢复正常解剖外形者。树脂充填（C错）、银汞充填（D错）多用于龋洞等的永久充填。